属于器官特异性自身免疫病的是
A. SLE
B. 全身性硬皮病
C. 多发性肌炎
D. 斯耶格拉伦综合征
E. 甲状腺机能亢进症（Graves病）

正确答案：E。甲状腺机能亢进症（Graves病）

解析：Graves病由促甲状腺激素受体抗体（TSHR）引起。甲状腺激素的产生受腺垂体分泌的甲状腺刺激激素（TSH）调节。TSH结合TSHR后可刺激甲状腺激素的合成。机体产生的针对TSHR的IgG抗体可结合TSHR，持续刺激甲状腺细胞分泌过多的甲状腺素，使患者出现甲状腺功能亢进。掌握“自身免疫概述以及临床常见自身免疫性疾病”知识点。